关于脊髓的描述何者是不正确的
A. 脊髓呈前后稍扁的圆柱形
B. 传入脊髓的感觉冲动经后根进入
C. 脊神经的前、后根都连于脊髓
D. 前根是由前角运动神经元轴突构成,后根是由后角感觉神经元树突构成
E. 脊髓下端平第1腰椎下缘

正确答案：D。前根是由前角运动神经元轴突构成,后根是由后角感觉神经元树突构成

解析：脊髓呈前、后稍扁的圆柱形（A对），上端在枕骨大孔处与延髓相连，下端变细呈圆锥状称脊髓圆锥,尖端约平对第1腰椎下缘（E对）。前根连于脊髓前外侧沟，由运动性神经根丝构成。后根连于脊髓后外侧沟，由感觉性神经根丝构成（BC对D错，为本题正确选项）。